溃疡性结肠炎患者容易并发中毒性巨结肠的情况是
A. 重症患者接受激素治疗时
B. 重症患者接受水杨酸柳氮磺胺吡啶治疗时
C. 重症患者接受胆碱能受体拮抗剂时
D. 重症患者接受抗生素治疗时
E. 重症患者接受全胃肠道外营养治疗时

正确答案：C。重症患者接受胆碱能受体拮抗剂时

解析：胆碱能受体拮抗剂可抑制受体节后胆碱能神经支配的平滑肌与腺体活动，使肠壁平滑肌张力极度下降，诱发中毒性巨结肠（C对）。另外，溃疡性结肠炎患者也常因低钾、钡剂灌肠、使用阿片类制剂而诱发中毒性巨结肠。激素（A错）、柳氮磺胺吡啶（B错）、抗生素（D错）、全肠道外营养治疗（E错）均不是中毒性巨结肠的诱因。